为中和胃酸保护胃黏膜宜选用
A. 奥美拉唑+阿莫西林+克拉霉素
B. 兰索拉唑
C. 硫糖铝
D. 颠茄
E. 甲氧氯普胺

正确答案：C。硫糖铝

解析：本题考查硫糖铝。为中和胃酸保护胃黏膜宜选用硫糖铝（C对）。硫糖铝在胃中酸性环境下分解成硫酸蔗糖和氢氧化铝，可以中和胃酸，形成胃黏膜保护屏障。奥美拉唑+阿莫西林+克拉霉素（A错）用于根除幽门螺杆菌感染。兰索拉唑（B错）为抑酸剂。颠茄（D错）为解痉药。甲氧氯普胺（E错）是促胃肠动力药。